氟水含漱不适宜在哪种人群中推广
A. 婴幼儿
B. 中小学校的学生
C. 龋活动性高的易感成人
D. 戴固定矫治器的儿童
E. 不能自己实行口腔卫生的残疾人

正确答案：A。婴幼儿

解析：含漱：使用漱口水时，根据儿童的年龄，用量筒或注射器取5ml或10ml配好的溶液于漱口杯中，5～6岁儿童每次用5ml，6岁以上儿童每次用10ml，嘱儿童将溶液含入口中，鼓漱1分钟后吐出，半小时内不进食或漱口。适用范围：含氟漱口液适用龋高发的人群。龋活跃性较高或易感人群、配戴正畸固定矫治器者以及一些不能实行自我口腔护理的残疾人均可使用。掌握“氟的全身及局部应用”知识点。